由甲状舌导管残余上皮发生的囊肿称为
A. 鳃裂囊肿
B. 口腔淋巴上皮囊肿
C. 甲状舌管囊肿
D. 异位甲状腺
E. 皮下囊肿

正确答案：C。甲状舌管囊肿

解析：甲状舌管囊肿是甲状舌导管残余上皮发生的囊肿。掌握“甲状舌管囊肿”知识点。